男，32岁。3天前淋雨，次日出现寒战、高热，继之咳嗽，咳少量粘液脓性痰，伴右侧胸痛。查体T39℃，急性病容，口角和鼻固有疱疹。心率110次/分，律齐。血WBC11×10⁹/L，最可能的诊断是
A. 急性肺脓肿
B. 干酪性肺炎
C. 葡萄球菌肺炎
D. 肺炎支原体肺炎
E. 肺炎链球菌肺炎

正确答案：E。肺炎链球菌肺炎

解析：患者为青年男性（肺炎链球菌肺炎的好发年龄），3天前淋雨（提示前驱感染史），出现寒战高热，咳少量粘液脓性痰，伴右侧胸痛，口角和鼻固有疱疹，根据其临床表现和体征，可考虑诊断为肺炎链球菌肺炎（E对），查体T39℃，血WBC11×10⁹/L（正常值4～10×10⁹/L）支持此诊断。急性肺脓肿（A错）（P57）临床特征为高热、咳嗽和咳大量脓臭痰。干酪性肺炎（B错）（P68）是继发性肺结核的一种，有咳嗽咳痰，痰中带血等症状，该患者无结核杆菌感染的典型体征，如盗汗、乏力、低热等结核中毒在症状。葡萄球菌肺炎（C错）（P47）常发生于有基础疾病如糖尿病、血液病、艾滋病、肝病、营养不良、酒精中毒、静脉吸毒或原有支气管肺疾病者，可早期出现循环衰竭。肺炎支原体肺炎（D错）（P49）多为阵发性刺激性呛咳，症状主要有乏力、咽痛、头痛、咳嗽、发热、食欲不振、腹泻、肌痛、耳痛等，血白细胞正常或略高。